女，22岁。突发右侧胸痛伴胸闷1小时，搬重物时突发右侧胸痛，疼痛剧烈，深呼吸时加重，伴刺激性咳嗽，继之出现胸闷，进行性加重，BP100/65mmHg，最可能的诊断是
A. 肺栓塞
B. 自发性气胸
C. 主动脉夹层
D. 肋间神经痛
E. 心肌梗死

正确答案：B。自发性气胸

解析：患者青年女性，突发右侧胸痛伴胸闷（气胸典型症状为单侧胸痛胸闷），血压100/65mmHg（正常值90～120/60～90mmHg，血压正常），最可能的诊断考虑自发性气胸（B对）。肺栓塞（A错）表现为呼吸困难及气促，尤以活动后明显；胸痛，包括胸膜炎性胸痛或心绞痛样疼痛；晕厥；烦躁不安、惊恐甚至濒死感；咯血；咳嗽、心悸；另有发绀，肺部哮鸣音和（或）细湿啰音；心动过速，血压变化，严重时可出现血压下降甚至休克。主动脉夹层（C错）表现为突发左侧胸背部疼痛，伴有高血压。肋间神经痛（D错）多为单侧受累，也可以双侧同时受累。咳嗽、深呼吸或打喷嚏往往使疼痛加重。查体可有胸椎棘突，棘突间或椎旁压痛和叩痛，少数患者沿肋间有压痛，受累神经支配区可有感觉异常。其疼痛性质多为刺痛或灼痛，有沿肋间神经放射的特点。心肌梗死（E错）患者在起病前1～2天或1～2周有前驱症状，最常见的是原有的心绞痛加重，发作时间延长，或对硝酸甘油效果变差；或继往无心绞痛者，突然出现长时间心绞痛。典型的心肌梗死症状为突然发作剧烈而持久的胸骨后或心前区压榨性疼痛，休息和含服硝酸甘油不能缓解，常伴有烦躁不安、出汗、恐惧或濒死感。